伤寒最显著的病理改变部位是在
A. 肠系膜淋巴结
B. 回盲部
C. 脾
D. 回肠末端
E. 肝

正确答案：D。回肠末端